早产儿，孕龄32，自然分娩，出生后2小时出现呼吸困难，进行加重。查体：面紫，呻吟，三凹征阳性，支气管声低，未闻及啰音，腹软，肝下2cm。该病的发病机制为
A. 肺表面活性物质缺乏
B. 肺炎引起
C. 肺泡液挤出障碍
D. 宫内缺氧
E. 宫内窘迫

正确答案：A。肺表面活性物质缺乏

解析：肺表面活性物质（PS）是由 Ⅱ 型肺泡上皮细胞合成并分泌的一种磷脂蛋白复合物，PS 覆盖在肺泡表面，其主要功能是降低其表面张力，防止呼气末肺泡萎陷 ，以保持功能残气量（FRC）, 维持肺顺应性，稳定肺泡内压和减少液体自毛细血管向肺泡渗出。由于PS含量减少（A对），使肺泡表面张力增加，呼气末FRC降低，肺泡趋于萎陷。